成人失血1000毫升时
A. 血压升高，心率加快
B. 血压降低，心率加快
C. 血压升高，心率减慢
D. 血压降低，心率减慢
E. 血压和心率均不变

正确答案：B。血压降低，心率加快

解析：正常人体血量约为4.2～4.8L，当失血量达到正常血量的20%时（约1000ml）时，循环血量减少，机体的代偿功能将不足以维持正常血压，出现血压降低。大量失血时交感神经系统活动增强，机体出现心率加速（B对）。